患者脘腹痞塞不舒，胸膈满闷，头晕目眩，身重困倦，呕恶纳呆，口淡不渴，小便不利，舌苔白厚腻，脉沉滑，应诊断为
A. 噎膈
B. 鼓胀
C. 痞满
D. 胃痛
E. 积聚

正确答案：C。痞满

解析：痞满以胃脘痞塞，满闷不舒为主症，并有按之柔软，压之不痛，望无胀形的特点。发病缓慢，时轻时重，反复发作，病程漫长。多因饮食、情志、起居、寒温等因素诱发（C对）。噎膈是指吞咽食物哽噎不顺，饮食难下，或纳而复出的疾患（A错）。鼓胀初起脘腹作胀，食后尤甚，继而腹部胀大如鼓，重者腹壁青筋显露，脐孔突起，常伴乏力、纳差、尿少及齿衄、鼻衄、皮肤紫斑等出血现象，常有酒食不节、情志内伤、虫毒感染或黄疸、胁痛、癥积等病史（B错）。胃痛以上腹近心窝处胃脘部发生疼痛为特征，其疼痛有胀痛、刺痛、隐痛、剧痛等不同的性质。常伴食欲不振，恶心呕吐，嘈杂泛酸，嗳气吞腐等上消化道症状，多因天气变化、恼怒、劳累、暴饮暴食、饥饿、进食生冷干硬辛辣诱发，多有反复发作病史（D错）。腹内结块，或肿或痛，见症不一，即为积聚（E错）。